根据《药品召回管理办法》，关于药品召回的说法，错误的是
A. 按照性质划分，药品召回分为主动召回、责令召回两类
B. 一级召回、二级召回、三级召回的通知时限要求分别为72小时、48小时和24小时
C. 已经确定为假药劣药的，不适用药品召回程序
D. 省级药品监督管理部门应当对召回总结报告进行审查，并对召回效果进行评价

正确答案：B。一级召回、二级召回、三级召回的通知时限要求分别为72小时、48小时和24小时

解析：本题考查生产企业药品召回的时间规定。根据《药品召回管理办法》，关于药品召回的说法，错误的是一级召回、二级召回、三级召回的通知时限要求分别为72小时、48小时和24小时（B错，为本题正确答案）。一级召回在24小时内，二级召回在48小时内，三级召回在72小时内，通知到有关药品经营企业、使用单位停止销售和使用，同时向所在地省级药品监督管理部门报告。按照性质划分，药品召回分为主动召回、责令召回两类（A对）。药品召回是指药品生产企业，包括进口药品的境外制药厂商，按照规定程序收回已上市销售的存在安全隐患的药品，已经确认为假药劣药的，不适用召回程序（C对）。药品生产企业在召回完成后，应当对召回效果进行评价，向所在地省级药品监督管理部门提交药品召回总结报告。省级药品监督管理部门对报告进行审查，并对召回效果进行评价（D对），必要时组织专家进行审查和评价。